在随机抽样时，属于样本人群中的受检者，由于主观或客观原因未能接受检查，称为
A. 选择性偏倚
B. 无应答偏倚
C. 回忆偏倚
D. 报告偏倚
E. 检查者偏性

正确答案：B。无应答偏倚

解析：本题考查偏倚的种类。在随机抽样时，属于样本人群中的受检者，由于主观或客观原因未能接受检查，称为无应答偏倚（B对）。偏倚的种类：（一）选择性偏倚（A错）：在调查过程中样本人群的选择不是按照抽样设计的方案进行，而是随意选择，由于调查对象的代表性很差，破坏了同质性，使调查结果与总体人群患病情况之间产生误差，称为选择性偏倚。如用医院病例说明社会人群患病情况，显然会出现偏倚。（二）无应答偏倚：实际就是漏查。在随机抽样时，属于样本人群中的受检者，由于主观或客观原因未能接受检查，如未接受检查的人数达到抽样人数的30%，应答率仅有70%，结果就难以用来估计总体的现患率。（三）信息偏倚：在调查中虽然应答率很高，但在获得信息的过程中出现各种误差，结果产生了偏倚，称为信息偏倚。1.因检查器械等造成的测量偏倚。2.因调查对象引起的偏倚：在询问疾病的既往史和危险因素时，调查对象常常因时间久远，难以准确回忆而使回答不准确，这种偏倚称为回忆偏倚（C错）。有时调查对象对询问的问题不愿意真实回答，使结果产生误差，这种偏倚称为报告偏倚（D错）。如在调查个人收入情况时，常常得不到真实的回答。又如在调查口腔卫生习惯时，一些没有刷牙习惯的人有时不愿实说，而使记录不真实。3.因检查者引起的偏倚：由于检查者的某种原因造成检查结果有偏性，为检查者偏倚（E错）。检查者偏倚有两种：（1）检查者之间偏倚：一个调查队伍中往往有数名检查者，当他们对同一名受检查者做口腔检查时，由于标准掌握不一致，导致结果有误差，为检查者之间偏倚。（2）检查者本身偏倚：指一名检查者给一名患者（或健康者）做口腔检查时，前后两次检查结果不一致。4.标准一致性试验。